1，4-二氧吡啶环的4位为3-硝基苯基，能够通过血-脑屏障，选择性扩张脑血管，增加脑血流量，对局部缺血具有保护作用的药物是
A. 硝苯地平
B. 尼群地平
C. 尼莫地平
D. 氨氯地平
E. 非洛地平

正确答案：C。尼莫地平

解析：本题考查钙通道阻滞剂抗心绞痛药的结构特征与作用。尼莫地平（C对）的1，4-二氧吡啶环的4位为3-硝基苯基，容易通过血-脑屏障，选择性扩张脑血管，在增加脑血流量的同时不影响脑代谢，具有抗缺血和抗血管收缩作用。硝苯地平（A错）1，4-二氧吡啶环的4位为2-硝基苯基，为对称结构的二氢吡啶类药物，可扩张周边血管。用于治疗冠心病，缓解心绞痛。尼群地平（B错）1，4-二氧吡啶环的4位虽然也是3-硝基苯基，但是它是选择性作用于血管平滑肌的钙通道阻滞剂，它对血管的亲和力比对心肌大，对冠状动脉的选择性作用更强，能降低心肌耗氧量，对缺血性心肌有保护作用。氨氯地平（D错）的1，4-二氧吡啶环的4位为2-氯-苯基，其生物利用度近100%，主要在肝脏代谢为氧化的吡啶衍生物，无药理活性。非洛地平（E错）的1，4-二氧吡啶环的4位为2，3-二氯-苯基，本品为选择性钙离子拮抗药，临床用于治疗高血压，可单用或与其它降压药合用。